男，49岁。湖北农民，发热、头痛1天.查体：T39℃，皮肤黄染，双下肢可见少见岀血点，结膜充血，肝肋下2cm，压痛阳性，脾肋下未触及，腓肠肌压痛明显。血常规：WBC15.0×10⁹/L，N0.88，Hb100g/L，ALT215U/L，AST120U/L。所患疾病的传播途径是
A. 疫水接触史
B. 蚊虫叮咬
C. 跳蚤叮咬
D. 尾蚴叮咬
E. 蜱虫叮咬

正确答案：A。疫水接触史

解析：中年男性患者。湖北农民（发病地区流行钩端螺旋体，即疫区接触史），有发热头痛病史。体查：高热伴有黄疸、肝大、肝脏压痛，腓肠肌压痛明显（感染钩端螺旋体表现）。血常规：WBC15.0×10⁹/L（正常值：3-10×10⁹/L），N0.88（正常值：0.4-0.7），Hb100g/L（正常值：成年男性120-160g/L），ALT215U/L（正常值：0-40U/L），AST120U/L（正常值：0-40U/L）（提示肝脏损害），综上所述，患者考虑诊断为钩端螺旋体感染，故所患疾病的传播途径为疫水接触史（A对）。蚊虫叮咬一般传播乙脑和疟疾（B错）。跳蚤叮咬一般情况下不传染疾病（C错）。尾蚴叮咬一般传播血吸虫病（D错）。蜱虫叮咬可传播很多疾病，如森林脑炎、莱姆病等（E错）。